外伤致上颌骨骨折，鼻腔发生明显出血。以上出血情况应选用的正确止血方法是
A. 钳夹、结扎止血法
B. 区域阻断止血法
C. 填塞止血法
D. 低温、降压止血法
E. 电灼止血法

正确答案：C。填塞止血法

解析：填塞止血法：可用于开放性和洞穿性创口、窦腔出血。一般将无菌纱布或碘仿纱条填塞于创口内，再用绷带行加压包扎。在颈部或口底创口填塞纱布时，应注意保持呼吸道通畅，防止发生窒息。鼻腔出血，在确定无脑脊液漏后才可填塞。掌握“口外手术组织切开、止血及组织分离”知识点。